氯化消毒中具有杀菌能力的化合氯是
A. NH₂Cl
B. Cl⁻
C. NCl₃
D. HOCl
E. OCl⁻

正确答案：A。NH₂Cl

解析：本题考查氯化消毒中具有杀菌能力的化合氯。余氯可分为化合性余氯和游离性余氯，化合性余氯指水中氯与氨的化合物，如NH₂Cl（A对BC错）和NHCl₂，以NHCl₂较稳定，杀菌效果好。游离性余氯指水中的OCl⁻（E错）、HOCl（D错）、Cl₂等，杀菌速度快，杀菌力强。但消失快。